下列尘肺（矽肺）患者的安置原则哪项是错误的
A. 一经确诊为尘肺，不论期别均应调离接尘岗位
B. 劳动能力未受影响或只属减退者，可安排做较轻劳动的非接尘工作
C. 劳动能力显著减退者只能安排做力所能及的非接尘工作
D. 丧失劳动能力者，不安排任何工作
E. Ⅰ期合并肺结核者，按诊断为Ⅱ期安排工作

正确答案：E。Ⅰ期合并肺结核者，按诊断为Ⅱ期安排工作

解析：本题考查尘肺患者的安置原则。尘肺病人的安置原则如下：1.尘肺一经确诊，不论期别，均应及时调离接尘作业（A对），不能及时调离的，必须报告当地劳动、卫生行政主管部门，设法尽早调离；2.伤残程度轻者（六级、七级），可安排在非接尘作业岗位从事劳动强度不大（B对）的工作；3.伤残程度中等者（四级），可安排在非接尘作业岗位做些力所能及（C对）的工作，或在医务人员的指导下，从事康复活动；4.伤残程度重者（二级、三级），不担负任何工作（D对），在医务人员指导下从事康复活动。根据规定要求，尘肺一期伴肺结核（E错，为本题正确答案）按照尘肺致残四级对待，可安排在非接尘作业岗位做些力所能及的工作，或在医务人员的指导下，从事康复活动。